《突发公共卫生事件应急条例》规定，医疗卫生机构应当对传染病做到
A. 早发现、早观察、早隔离、早治疗
B. 早报告、早观察、早治疗、早康复
C. 早发现、早报告、早隔离、早治疗
D. 早发现、早报告、早隔离、早康复
E. 早预防、早发现、早治疗、早康复

正确答案：C。早发现、早报告、早隔离、早治疗

解析：《突发公共卫生事件应急条例》规定，医疗卫生机构应当对传染病做到早发现、早报告、早隔离、早治疗（C对），切断传播途径，防止扩散。